金匮肾气丸适用于糖尿病的哪种证型
A. 阴虚阳盛
B. 气阴两虚
C. 阴阳两虚
D. 阴阳欲绝
E. 气虚血瘀

正确答案：C。阴阳两虚

解析：金匮肾气丸加减可以滋阴温阳，补肾固摄，用于治疗糖尿病阴阳两虚证（C对）。阴虚阳盛证（A错）的治法为滋阴补肾，方药用六味地黄丸加减。气阴两虚证（B错）的治疗需益气健脾，生津止渴，方药用七味白术散加减。阴阳欲绝证（D错）不属于糖尿病的基本证型。气虚血瘀证（E错）治疗需益气活血，方药用血府逐瘀汤加减。